金瓷冠的禁忌证为
A. 前牙错位牙
B. 锥形牙
C. 固定桥固位体
D. 年轻恒牙
E. 四环素牙

正确答案：D。年轻恒牙

解析：金瓷冠的禁忌证①青少年恒牙因尚未发育完全，牙髓腔较大者。②牙体过小无法取得足够的固位形和抗力形者。③严重深覆（牙合）、咬合紧，而无法预备出足够的空间者。掌握“修复体试戴、磨光与粘固”知识点。